根据《互联网药品交易服务审批暂行规定》，向个人消费者提供互联网药品交易服务的企业，应当具备的条件不包括
A. 是依法设立的药品批发企业
B. 具有负责网上实时咨询的执业药师
C. 对上网交易的品种有完整的管理制度与措施
D. 具有完整保存交易记录的能力、设施和设备
E. 具有与上网交易的品种相适应得药品配送系统

正确答案：A。是依法设立的药品批发企业

解析：本题考查《互联网药品交易服务审批暂行规定》。根据《互联网药品交易服务审批暂行规定》，向个人消费者提供互联网药品交易服务的企业，应当具备的条件不包括是依法设立的药品批发企业（A错，为本题正确答案）。《互联网药品交易服务审批暂行规定》第九条：向个人消费者提供互联网药品交易服务的企业，应当具备以下条件：（一）依法设立的药品连锁零售企业；（二）提供互联网药品交易服务的网站已获得从事互联网药品信息服务的资格；（三）具有健全的网络与交易安全保障措施以及完整的管理制度；（四）具有完整保存交易记录的能力、设施和设备（D对）；（五）具备网上咨询、网上查询、生成订单、电子合同等基本交易服务功能；（六）对上网交易的品种有完整的管理制度与措施（C对）；（七）具有与上网交易的品种相适应的药品配送系统（E对）；（八）具有执业药师负责网上实时咨询（B对），并有保存完整咨询内容的设施、设备及相关管理制度；（九）从事医疗器械交易服务，应当配备拥有医疗器械相关专业学历、熟悉医疗器械相关法规的专职专业人员。